细菌学诊断中，关于标本的采集原则，说法不正确的是
A. 尽量在发病早期未使用抗生素之前采集
B. 严格无菌环境进行操作采集
C. 根据不同病种及检验目的确定采集不同标本
D. 标本采样后，做好标记尽快冷藏送检
E. 奈瑟氏菌标本需在冷藏环境下送检

正确答案：E。奈瑟氏菌标本需在冷藏环境下送检

解析：奈瑟氏菌标本采集为特例，需要在室温下立即送检。掌握“细菌学、血清学诊断及感染防治”知识点。